恒牙列中龋病最不好发的牙位是
A. 下颌第二乳磨牙
B. 上颌第二乳磨牙
C. 乳下前牙
D. 下颌第一磨牙
E. 下前牙

正确答案：E。下前牙

解析：恒牙列中，患龋最少见的是下前牙。掌握“龋病的临床表现与分类”知识点。